女，62岁。间断咳嗽，咳少量白粘痰10年。查体：双肺呼吸音粗，未闻及干湿性啰音。血常规正常。胸部X线片示肺纹理增粗紊乱，肺功能示FEV₁占预计值83%，FEV₁/FVC=67%（舒张后）。该患者最可能的诊断是
A. 支气管哮喘
B. 特发性肺纤维化
C. 支气管肺结核
D. 慢性阻塞性肺疾病
E. 支气管扩张

正确答案：D。慢性阻塞性肺疾病

解析：患者为老年女性，间断咳嗽，咳少量白痰10年余（COPD常见临床表现）。查体：双肺呼吸音清，未闻及干湿啰音。胸部X线片示肺纹理增粗紊乱，肺功能：肺功能示FEV₁占预计值83%（FEV₁≥预计值80%，轻度肺功能不全），FEV₁/FVC=67%（＜70%提示存在持续气流受限），考虑诊断为慢性阻塞性肺疾病（COPD）（D对）。支气管哮喘（A错）（P30）和COPD最主要鉴别点是气流受限可逆，即支气管哮喘肺功能检查FEV₁/FVC应大于70%。特发性肺纤维化（B错）（P90）属于间质性肺疾病，主要表现为进行性加重的呼吸困难、限制性通气功能障碍伴弥散功能降低、低氧血症，双肺基底部可闻及Velcro啰音，患者并无相关症状。支气管结核（C错）（P65）会有全身中毒症状如发热盗汗，可有咯血，累及胸膜时可有胸痛。支气管扩张（E错）（P37）多见于青少年，主要表现为持续或反复的咳嗽、咳痰或咳脓痰，听诊时有固定部位的湿啰音，胸部X线检查时，可看到“双轨征”及“环形阴影”。